上腹部疼痛同时有咽喉部及胸骨后疼痛的急性胃炎是
A. 单纯性
B. 腐蚀性
C. 感染性
D. 出血性
E. 化脓性

正确答案：B。腐蚀性